以上哪种疾病的病理特点为肿物中含有成熟的牙釉质、牙本质、牙骨质和牙髓组织
A. 成釉细胞瘤
B. 牙瘤
C. 牙源性角化囊性瘤
D. 化脓性腮腺炎
E. 含牙囊肿

正确答案：B。牙瘤

解析：牙瘤是成牙组织的错构瘤或发育畸形，不是真性肿瘤。肿物内含有成熟的牙釉质、牙本质、牙骨质和牙髓组织。掌握“牙源性角化囊性瘤”知识点。